克林霉素具有强大的抗菌作用主要是对
A. 需氧菌
B. 厌氧菌
C. 肠球菌
D. 肺炎支原体
E. G-杆菌

正确答案：B。厌氧菌